属于神经氨酸酶抑制剂的是
A. 奥司他韦
B. 伐昔洛韦
C. 博洛昔韦
D. 阿昔洛韦
E. 扎那米韦

正确答案：A、E。奥司他韦；扎那米韦

解析：本题考查抗病毒药的类型。神经氨酸酶抑制剂有：奥司他韦（A对）、扎那米韦（E对）、帕拉米韦、拉尼米韦。